以下哪种不是黏附分子家族
A. 整合素家族
B. 选择素家族
C. 免疫球蛋白超家族
D. 钙黏蛋白家族
E. 钙调蛋白家族

正确答案：E。钙调蛋白家族